可转变为黑色素的物质是
A. 天冬酰胺
B. 谷氨酸
C. 谷氨酰胺
D. 酪氨酸
E. 精氨酸

正确答案：D。酪氨酸